既疏散风热，又解毒的药是
A. 柴胡
B. 淡豆豉
C. 浮萍
D. 葛根
E. 升麻

正确答案：E。升麻

解析：本题考查的是升麻的功效。既疏散风热，又解毒的药是升麻（E对）。升麻：【功效】发表透疹，清热解毒，升举阳气。柴胡（A错）：【功效】解表退热，疏肝解郁，升举阳气。淡豆豉（B错）：【功效】解表，除烦。浮萍（C错）：【功效】发汗解表，透疹止痒，利水消肿。葛根（D错）：【功效】解肌退热，透疹，生津，升阳止泻。